用热远热属于
A. 扶正
B. 祛邪
C. 治标
D. 反治法
E. 三因制宜

正确答案：E。三因制宜

解析：用热远热指使用热性药物应避开火热生令之时，即气候炎热之际不宜用大温大热的药物或食物；是因时制宜的一种体现（E对）。扶正指用扶持助长机体正气的治则，使正气充足以消除病邪，恢复健康（A错）。祛邪指用祛除病邪的治则，使邪去正复，恢复健康（B错）。治标指“标”危急，先采用治标的原则（C错）。反治法指顺从病证的外在假象而治的治则（D错）。